下列属于原络配穴法的是
A. 合谷、偏历
B. 太溪、大钟
C. 太渊、列缺
D. 合谷、列缺
E. 冲阳、丰隆

正确答案：D。合谷、列缺

解析：本题主要考查原络配穴法的定义。原络配穴法是表里经配穴的典型实例，是先病经脉的原穴与后病的相表里的经脉的络穴相配合治疗疾病的配穴方法。合谷为手阳明大肠经的原穴，列缺为手太阴肺经的络穴，肺与大肠相表里，属原络配穴法（D对）。合谷、偏历为手阳明大肠经的原穴和络穴，不是表里经配穴（A错）。太溪、大钟是足少阴肾经的原穴和络穴，不是表里经配穴（B错）。太渊、列缺为手太阴肺经的原穴和络穴，不是表里经配穴（C错）。冲阳、丰隆为足阳明胃经的原穴和络穴，不是表里经配穴（E错）。